下列哪种气体不能引起温室效应
A. CO
B. CO₂
C. CH₄
D. N₂O
E. 含氯氟烃

正确答案：A。CO

解析：本题考查温室效应的相关内容。大气层中某些气体如CO₂等能吸收地表发射的热辐射，使大气增温，称为温室效应。这些气体统称为温室气体，主要包括CO₂（B对）、甲烷（CH₄）（C对）、氧化亚氮（N₂O）（D对）和氯氟烃（CFC）（E对）等。CO（A错，为本题正确答案）不能引起温室效应。